下列不宜采用塑化疗法的是
A. 乳牙
B. 年轻恒牙
C. 成熟恒前牙
D. 成熟恒后牙
E. A、B、C三项

正确答案：E。A、B、C三项

解析：本题考查塑化治疗。塑化治疗是去除冠髓和大部分根髓，根管消毒后，用尚未聚合的液态塑化液注入根管中，在聚合前可渗透到残余的牙髓组织及根管内的感染物质，和这些物质一起聚合从而封闭根管，塑化治疗操作简单，效果明显，但塑化液引起牙齿变色，故前牙和年轻恒牙不宜采用塑化治疗（BC错）。乳牙塑化治疗影响乳牙的生理性吸收，使乳恒牙不能正常替换，导致乳牙滞留，恒牙的异位萌出（A错）。综上所述，乳牙、年轻恒牙和成熟恒前牙不宜采用塑化治疗（E为本题的正确答案）。